中毒性菌痢最严重的临床表现是
A. 起病急骤
B. 高热
C. 惊厥
D. 循环衰竭和呼吸衰竭
E. 昏迷

正确答案：D。循环衰竭和呼吸衰竭

解析：中毒性菌痢最严重的临床表现是循环衰竭和呼吸衰竭（D对），为混合型的临床表现，其死亡率高达90%以上。起病急骤（A错）、高热（B错）可见于普通型菌痢；惊厥（C错）、昏迷（E错）可见于中毒性菌痢中的脑型；以上两者并非最严重的临床类型（八版传染病学P180）。